立克次体感染宜选
A. 链霉素
B. 四环素
C. 磺胺嘧啶
D. 阿齐霉素
E. 多粘菌素

正确答案：B。四环素

解析：四环素类药物属于快速抑菌药，首选治疗立克次体感染（斑疹伤寒、Q热和恙虫病）。掌握“四环素、多西环素及米诺环素”知识点。